下列有关阿托品的描述中，正确的是
A. 对胆管解痉作用较强
B. 能抑制胃肠道平滑肌痉挛
C. 对多种内脏平滑肌有收缩作用
D. 增加蠕动的幅度和频率
E. 以上说法均正确

正确答案：B。能抑制胃肠道平滑肌痉挛

解析：阿托品对多种内脏平滑肌有松弛作用，尤其对过度活动或痉挛的平滑肌作用更为显著。它可抑制胃肠道平滑肌痉挛，降低蠕动的幅度和频率，缓解胃肠绞痛。阿托品也可降低尿道和膀胱逼尿肌的张力和收缩幅度。阿托品对胆管、支气管平滑肌的解痉作用较弱。掌握“阿托品”知识点。